下列哪种说法是正确的
A. 发病率和患病率是一样的
B. 现患率和患病率是不一样的
C. 患病率指一定时期内特定人群中发生某病的新病例的频率
D. 发病率指某特定时期内人口中新旧病例所占的比例
E. 发病率的分母中不包括具有免疫力和现患病而不会发病的人

正确答案：E。发病率的分母中不包括具有免疫力和现患病而不会发病的人

解析：本题考查发病率和患病率的概念。发病率是指一定时间内，一定范围人群中某病新发生病例的频率。发病率的分母应选择暴露人口，暴露人口不包括已患病和对疾病具有持久免疫力的群体（E对）。发病率和患病率概念不同（A错），发病率是新发病例（D错）数占暴露人口的比例，患病率是指某特定时间内总人口中某病新旧病例数（C错）占同时期平均人口数的比例。患病率又被称作现患率（B错）。